引起疯牛病和人类克雅病、库鲁病等的病原体是
A. 病毒（virus）
B. 类病毒（viroid）
C. 拟病毒（virusoid）
D. 朊粒（prion）
E. 衣原体（chlamydia）

正确答案：D。朊粒（prion）